属于康复期患者心理问题的干预的是
A. 培养积极的情绪状态
B. 动员心理的代偿功能
C. 纠正错误的认知
D. 康复运动锻炼的心理效应
E. 以上均正确

正确答案：E。以上均正确

解析：康复期患者心理问题的干预包括：培养积极的情绪状态；动员心理的代偿功能；纠正错误的认知；康复运动锻炼的心理效应；各种积极的社会因素都有利于患者的康复。掌握“特殊患者心理”知识点。